某男，24岁。右侧肩胛骨内缘突发疖肿，周围色红肿硬，触痛明显，伴有恶寒，发热，口干，尿黄，大便干；舌红苔黄腻，脉滑数。证属湿毒瘀结。宜选用的中成药是
A. 连翘败毒丸
B. 皮肤病血毒丸
C. 牛黄化毒片
D. 活血解毒丸
E. 活血消炎丸

正确答案：B。皮肤病血毒丸

解析：本题考查的是疖的辨证论治。右侧肩胛骨内缘突发疖肿，周围色红肿硬，触痛明显，伴有恶寒，发热，口干，尿黄，大便干；舌红苔黄腻，脉滑数。证属湿毒瘀结。宜选用的中成药是皮肤病血毒丸（B对）。疖是指发生在肌肤浅表部位、范围较小的急性化脓性疾病。（一）热毒蕴结证：【中成药应用】常用中成药有连翘败毒丸（A错）、芩连片、清热暗疮片、龙珠软膏、如意金黄散。（二）湿毒蕴结证：【中成药应用】常用中成药有皮肤病血毒丸、老鹳草软膏。（三）阴虚内热证：【中成药应用】常用中成药有知柏地黄丸。牛黄化毒片（C错）为乳痈热毒炽盛证的中成药应用。乳痈热毒炽盛证：【中成药应用】常用中成药有牛黄化毒片、九一散。活血解毒丸（D错）与活血消炎丸（E错）为乳痈气滞热壅证的中成药应用。乳痈气滞热壅证：【中成药应用】常用中成药有活血解毒丸、活血消炎丸。